以下哪个描述与氯化琥珀胆碱不符
A. 白色结晶性粉末
B. 为骨骼肌松弛药
C. 与氢氧化钠加热，产生三甲胺臭味
D. 水溶液稳定，不被水解
E. 本品在酸性介质中加入硫氰酸铬铵生成不溶性复盐

正确答案：D。水溶液稳定，不被水解